患者，女，30岁。有慢性粒细胞性白血病史。形体消瘦，面色晦暗，胸痛，胁下痞块坚硬，皮肤有瘀斑，舌质紫暗，脉细涩。中医治法是
A. 益气养阴
B. 凉血活血
C. 清热解毒
D. 活血化瘀
E. 健脾益肾

正确答案：D。活血化瘀

解析：瘀血阻滞，血不荣养肌肉筋脉，故见形体消痩，面色晦暗；不通则痛，故胸痛，胁下痞块坚硬；血溢脉外则皮肤瘀斑；舌质紫暗，脉细涩均为瘀血内阻之侯，治法应为活血化瘀（D对）。益气养阴（A错）适用于气血两虚证。凉血活血（B错）适用于血热妄行证。清热解毒（C错）适用于热毒壅盛证。健脾益肾（E错）适用于脾肾两虚之证。